胎心减速出现在宫缩高峰后，下降慢，持续时间长，恢复慢，临床提示的情况是
A. 宫缩时胎头受压
B. 胎儿受镇静药物影响
C. 宫缩时脐带受压，兴奋迷走神经
D. 胎儿缺氧
E. 胎儿状况良好

正确答案：D。胎儿缺氧

解析：加速的特点为胎心基线暂时增加，持续时间＞15秒，提示胎儿状况良好（E错），原因可能是胎儿躯干局部或脐静脉暂时受压。早期减速的特点为胎心减速与宫缩同时开始，持续时间短，恢复快，一般发生在第一产程后期，提示宫缩时胎头受压（A错）。变异减速的特点为胎心减速与宫缩无固定关系，下降迅速且下降幅度大，持续时间长短不一，恢复也迅速，提示宫缩时脐带受压兴奋迷走神经（C错）。晚期减速的特点为胎心减速出现在宫缩高峰后，下降慢，持续时间长，恢复慢，提示胎盘功能不良、胎儿缺氧（D对）。胎心率与胎儿受镇静药物影响（B错）无关，胎儿受镇静药物影响可能会抑制胎儿神经的活动，并影响脑的发育。